可用于治疗早产儿、新生儿低凝血酶原血症的维生素是
A. 维生素B₆
B. 维生素C
C. 维生素A
D. 维生素B₂
E. 维生素K

正确答案：E。维生素K

解析：本题考查维生素K。可用于治疗早产儿、新生儿低凝血酶原血症的维生素是维生素K（E对）。维生素B₆（A错）可预防周围神经炎。维生素C（B错）长期大量使用可致泌尿系统尿酸盐、半胱氨酸盐或草酸盐结石。维生素A（C错）有促进生长、繁殖，维持骨骼、上皮组织、视力和黏膜上皮正常分泌等多种生理功能。维生素B₂（D错）可用来防治口角炎、唇炎、舌炎、眼结膜炎和阴囊炎等。